动脉血压升高可引起
A. 心室等容收缩期延长
B. 心室快速射血期延长
C. 心室减慢射血期延长
D. 心室快速充盈期延长
E. 心室减慢充盈期延长

正确答案：A。心室等容收缩期延长

解析：心室处于等容收缩期时，心室压力急剧升高，当室内压大于主动脉压时，主动脉瓣开放，心室进入快速射血期。动脉血压升高时，心室等容收缩期延长（A对）才能使室内压大于主动脉压，主动脉瓣开放进入快速射血期。动脉血压升高，心室射血期不会延长（BC错）。动脉血压升高与舒张充盈期关系不大（DE错）。